穿梨状肌上孔的结构是
A. 臀上神经
B. 臀下神经
C. 臀下血管
D. 阴部神经
E. 无

正确答案：A。臀上神经

解析：臀上神经（A对）伴臀上血管经梨状肌上孔出盆腔至臀部。臀下神经（B错），伴随臀下血管（C错）经梨状肌下孔出盆腔至臀部。阴部神经（D错）伴随阴部血管穿出梨状肌下孔至臀部。